根据《处方管理办法》，保存期满的处方销毁须
A. 经医疗机构主要负责人批准、登记备案
B. 经县以上卫生行政部门批准、登记备案
C. 经县以上药品监督管理部门批准、登记备案
D. 经县以上监察部门批准、登记备案
E. 经医疗机构的药学部门批准、登记备案

正确答案：A。经医疗机构主要负责人批准、登记备案

解析：本题考查的是处方的监督管理。根据《处方管理办法》，保存期满的处方销毁须经医疗机构主要负责人批准、登记备案（A对）。处方由调剂处方药品的医疗机构妥善保存。普通处方、急诊处方、儿科处方保存期限为1年，医疗用毒性药品处方保存期限为2年。麻醉药品、精神药品等特殊药品处方保存期限按照特别规定。处方保存期满后，经医疗机构主要负责人批准、登记备案，方可销毁。一般来说，处方销毁申请由处方保管人向药剂科主任提出，药剂科主任填写医院《处方销毁申请表》，报医务处、业务主管院长审批，由药剂科与医务处执行销毁。处方在销毁时，必须由两位药学专业技术人员核对销毁，并建立销毁记录，销毁后要及时做好销毁登记，监销人要进行双签字。